甲类传染病是指
A. SARS，狂犬病
B. 黑热病，炭疽
C. 高致病性禽流感，天花
D. 鼠疫，霍乱
E. 伤寒，流行性出血热

正确答案：D。鼠疫，霍乱